关于血-气分配系数说法错误的是
A. 血-气分配系数是药物经呼吸道吸收难易的评价指标
B. 在呼吸膜两侧分压达到平衡时，物质在血液中的浓度与在肺泡空气中的浓度之比
C. 血-气分配系数越大，气体越难被吸收入血
D. 血-气分配系数越低的外源化学物经肺吸收速率主要取决于经肺血流量

正确答案：C。血-气分配系数越大，气体越难被吸收入血

解析：本题考查血-气分配系数。血-气分配系数是指在呼吸膜两侧分压达到平衡时，物质在血液中的浓度与在肺泡空气中的浓度之比（B对）。它是药物经呼吸道吸收难易的评价指标（A对）。血-气分配系数越大的物质在血液中的溶解度越高，越容易被吸收（C错，为本题正确答案），达到平衡所需的时间也越长。肺通气量和经肺血流量对于维持气态物质在肺泡气和血液间的分压差具有重要意义。血-气分配系数大的物质，呼吸的频率和深度（通气限制）影响其到达肺泡气中的浓度，故肺通气量越大越有利于它们的吸收。血-气分配系数小的物质，经肺血流量（灌注限制）决定其吸收后被移走的速度，该流量越大则越有利于它们的吸收（D对）。